女，48岁。放置宫内节育器（IUD）10年，不规则阴道流血3个月。妇科检查：宫颈光滑。宫颈细胞学检查无异常。首选处理方法
A. 止血药治疗
B. 抗感染治疗
C. 取出IUD+诊断性刮宫术
D. 取出IUD+抗感染治疗
E. 人工周期治疗

正确答案：C。取出IUD+诊断性刮宫术

解析：该患者48岁（患者处于绝经过渡期，是指从开始出现绝经趋势直到最后一次月经的时期，始于40岁，历时1～20年不等），放置宫内节育器（IUD）10年（带铜宫内节育器一般放置5～7年，宫铜IUD可放置20年左右，患者应行IUD取出术），不规则阴道流血3个月（不规则阴道流血是放置IUD常见的副作用），宫颈光滑，宫颈细胞学检查无异常。因患者处于绝经过渡期，且子宫异常出血，应排除子宫颈癌、子宫内膜癌，故首选处理方法是取出IUD+诊断性刮宫术（C对DE错）明确诊断。止血药治疗（A错）、抗感染治疗（B错）是一般治疗，对不规则阴道流血治疗意义不大。